临床上常为咽部手术以及寻找或结扎舌动脉的重要解剖标志的是
A. 舌骨体上下
B. 舌骨大角
C. 舌骨小角
D. 舌肌
E. 舌外肌

正确答案：B。舌骨大角

解析：临床上舌骨大角是咽部手术以及寻找或结扎舌动脉的重要解剖标志。掌握“蝶骨、颞骨及舌骨的解剖特点”知识点。